根据卫生部等九部委局《关于建立国家基本药物制度的实施意见》，国家发展和改革委员会的职能是
A. 确定使用国家基本药物目录外药品品种数量
B. 制定国家基本药物药品标准
C. 审核国家基本药物目录
D. 监测和管理药品宏观经济
E. 确定配备使用国家基本药物目录外的民族药

正确答案：D。监测和管理药品宏观经济

解析：本题考查的是发展和改革宏观调控部门的职责。根据卫生部等九部委局《关于建立国家基本药物制度的实施意见》，国家发展和改革委员会的职能是监测和管理药品宏观经济（D对）。发展和改革宏观调控部门的职责：国家发展和改革委员会负责监测和管理药品宏观经济。2018年国务院机构改革，将国家发改委的价格监督检查与反垄断执法职责划入国家市场监督管理总局，国家发改委的药品和医疗服务价格管理职责划入国家医疗保障局。同时，国家发展和改革委员会负责组织监测和评估人口变动情况及趋势影响，建立人口预测预报制度，开展重大决策人口影响评估，完善重大人口政策咨询机制，研究提出国家人口发展战略，拟订人口发展规划和人口政策，研究提出人口与经济、社会、资源、环境协调可持续发展，以及统筹促进人口长期均衡发展的政策建议。基本药物管理部门及职能：国家基本药物工作委员会负责协调解决制定和实施国家基本药物制度过程中各个环节的相关政策问题，确定国家基本药物制度框架，确定国家基本药物目录遴选和调整的原则、范围、程序和工作方案，审核国家基本药物目录（C错），各有关部门在职责范围内做好国家基本药物遴选调整工作。国家基本药物工作委员会由国家卫生健康委员会、国家发展和改革委员会、工业和信息化部、监察部、财政部、人力资源和社会保障部、商务部、国家药品监督管理局、国家中医药管理局组成。办公室设在国家卫生健康委员会，承担国家基本药物工作委员会的日常工作。